1型糖尿病的临床表现是
A. 有明显的“三多一少”症状
B. 中老年多见
C. 肥胖者多见
D. 起病缓，症状轻
E. 对胰岛素较不敏感

正确答案：A。有明显的“三多一少”症状

解析：1型糖尿病的临床表现是有明显的“三多一少”的症状（A对），即多尿、多饮、多食和体重减轻。多见于青少年（B错），起病急，症状较明显（D错），胰岛素治疗有效（E错）。2型糖尿病多见于肥胖者（C错）。